目前诊断慢性胃炎最好的方法是
A. X线钡餐检查
B. 胃液分析
C. 胃镜加活检
D. 大便隐血试验
E. 幽门螺杆菌检查

正确答案：C。胃镜加活检

解析：目前诊断慢性胃炎最好的方法是胃镜加活检（C对），可以明确病变程度和病变性质。X线钡餐检查（A错）、胃液分析（B错）、幽门螺杆菌检查（E错）均可以作为慢性胃炎诊断的辅助手段，但诊断慢性胃炎最可靠的依据仍然是胃镜下直视检查及组织学检查。大便隐血试验（D错）是检查消化道出血的方法，当出血量在5～10ml时，大便隐血试验阳性。